急性肾功能衰竭少尿期或无尿期出现水中毒的常见原因是
A. 钠中毒
B. 酸中毒
C. 未严格限制入水量
D. 体内内生水过多
E. 抗利尿激素增加

正确答案：C。未严格限制入水量

解析：急性肾功能衰竭少尿期或无尿期因患者肾功能滤过功能严重受损，肾小球滤过率下降，已无法排出正常的尿量，会造成水潴留及稀释性低钠，而非钠中毒（A错），对于此种患者，应严格控制入水量（饮水及注射用水），如患者未严格限制入水量（C对），常常会导致水中毒。体内内生水量（D错）不大，平时约每天300ml，肾衰竭时虽然代谢会增强，导致内生水相应增多，但相对而言还是比较少的，不会导致水中毒。由于肾功能衰竭时水钠积蓄，机体抗利尿激素分泌减少以减轻水钠潴留，而不是抗利尿激素增加（E错）。酸中毒（B错）与水中毒的发生无关。